不是酸雨的有害作用
A. 使皮肤癌的发生率增加
B. 破坏农田和植被的化学组成
C. 增加土壤中重金属的水溶性
D. 影响土壤中生物的生存
E. 增加输水管材中金属的溶出

正确答案：A。使皮肤癌的发生率增加

解析：本题考查酸雨的有害作用。当降水的pH小于5.6时称为酸雨。酸雨对人类生态环境影响是多方面的，主要是酸雨对人群健康的危害。酸雨可破坏农田和植被的化学组成（B对）；增加土壤中重金属的水溶性（C对）；影响土壤中生物的生存（D对）；可造成地表水pH下降而使输水管材中的金属化合物易于溶出（E对）等。使皮肤癌的发生率增加（A错，为本题正确答案）不是酸雨的有害作用。